下列哪项疾病属于遗传性心肌病
A. 扩张型心肌病
B. 肥厚型心肌病
C. 限制型心肌病
D. 甲亢性心肌病
E. 病毒性心肌病

正确答案：B。肥厚型心肌病

解析：肥厚性心肌病为常染色体显性遗传病，具有遗传异质性（B对）。